关于片剂包衣目的的说法，错误的是
A. 隔绝空气、避光、防潮，提高药物的稳定性
B. 掩盖药物不良气味，增加用药的顺应性
C. 包薄膜衣可加快药物的溶出
D. 包肠溶衣可减少药物对胃的刺激
E. 包控释衣，可控制药物的释放速度

正确答案：C。包薄膜衣可加快药物的溶出

解析：本题考查的是片剂包衣的目的。关于片剂包衣目的的说法，错误的是包薄膜衣可加快药物的溶出（C错，为本题正确答案）。片剂包衣的目的：①隔绝空气，避光，防潮，提高药物的稳定性（A对）。②掩盖药物的不良气味，增加患者的顺应性（B对）。③控制药物在肠道内定位释放。包肠溶衣可避免药物对胃的刺激（D对），防止胃酸或胃酶对药物的破坏。包结肠定位肠溶衣可在结肠定位释放药物，治疗结肠部位疾病。④包缓释或控释衣，改变药物释放速度（E对），减少服药次数，降低不良反应。⑤隔离有配伍禁忌的成分，避免相互作用，有助复方配伍。⑥改善外观，使片剂美观，且便于识别。